患者，男，27岁。诊断为急性胰腺炎。上腹胀痛，痛引两胁，恶心呕吐，口干苦，大便不畅，舌淡红，苔薄白，脉弦。其证型是
A. 肝郁气滞
B. 肠胃热结
C. 肝胆湿热
D. 肝郁脾虚
E. 血瘀内停

正确答案：A。肝郁气滞

解析：患者为急性胰腺炎；气机郁滞不通故见上腹胀痛；肝经循于两胁肋部，故痛引两胁；肝气犯胃乘脾，故见恶心呕吐；肝气上逆则口干苦，大便不畅；舌淡红，苔薄白，脉弦，均为肝郁气滞证。治法为疏肝利胆，行气止痛，方药选用小柴胡汤加减（A对）。肠胃热结证（B错）的特点为全腹疼痛，痛而拒按，发热，口苦而干，脘腹胀满，大便秘结，小便短黄。肝胆湿热证（C错）的特点为上腹胀痛拒按，胁痛，或有发热，恶心呕吐，目黄身黄，小便短黄，大便不畅，舌红，苔薄黄或黄腻，脉弦数。肝郁脾虚证（D错）的特点为上腹及两胁胀痛，或时发剧痛，牵及胸背，倦怠乏力，嗳气，饮食减少，腹胀便溏，舌暗淡，苔薄白，脉弦细弱。血瘀内停证（E错）的特点为上脘腹刺痛，痛处固定，入夜尤甚，面色晦暗，腹部或有癥块，形体消瘦，纳呆，恶心呕吐，大便溏薄，舌紫暗，或有瘀点，脉弦涩。